流行病学研究方法的核心特征是
A. 群体的特征
B. 发展的特征
C. 对比的特征
D. 概率论与数理统计学的特征
E. 社会心理的特征

正确答案：C。对比的特征

解析：本题考查流行病学研究方法的核心特征。流行病学的特征包括群体的特征，对比的特征，概率论和数理统计学的特征，社会心理的特征，预防为主的特征，发展的特征。其中，对比的特征（C对ABDE错）是流行病学研究方法的核心特征。